下列哪种物质属干内生致热原？
A. 革兰阳性菌产生的外毒素
B. 革兰阴性菌产生的内毒素
C. 体内的抗原抗体复合物
D. 体内肾上腺皮质激素代谢产物
E. 巨噬细胞被激活后释放的IL-1

正确答案：E。巨噬细胞被激活后释放的IL-1

解析：内生致热原包括：白细胞介素-1（IL-1）（E对）、肿瘤坏死因子（TNF）、干扰素（IFN）、白细胞介素-6、巨噬细胞炎症蛋白-1等。外毒素（A错）、内毒素（B错）、抗原抗体复合物（C错）、体内肾上腺皮质激素代谢产物（D错）属于发热激活物。